作用上属抗雌激素类的药物是
A. 氢化可的松
B. 苯丙酸诺龙
C. 两者均是
D. 两者均不是

正确答案：D。两者均不是

解析：本题考查氢化可的松和苯丙酸诺龙的作用。氢化可的松（A错）为糖皮质激素类药物，有抗炎、抗免疫、抗毒素、抗休克作用。苯丙酸诺龙（B错）为临床常用的蛋白同化类激素。主要用于蛋白质吸收和合成不足，或分解亢进、损失过多的慢性衰弱和消耗性疾病患者，如营养不良、贫血、骨折不易愈合等。两者均不是抗雌激素类药物（D对C错）。